固定桥破损主要包括
A. 连接体折断
B. （牙合）面破损
C. 瓷层牙面破损
D. 树脂层牙面破损
E. 以上说法均正确

正确答案：E。以上说法均正确

解析：本题考查固定桥修复后出现的问题及处理。固定桥破损：固定桥修复牙列缺损后也可能会出现破损。（1）瓷层或树脂层牙面破损（CD对）；（2）连接体折断（A对）；（3）（牙合）面破损（B对）；（4）固位体、桥体牙面变色。因此选E。